下列各项，不属六味地黄丸主治证临床表现的是
A. 腰膝酸软，盗汗遗精
B. 耳鸣耳聋，头晕目眩
C. 骨蒸潮热，手足心热
D. 小便不利或反多
E. 舌红少苔，脉沉细数

正确答案：D。小便不利或反多

解析：本题考查六味地黄丸主治病证的临床表现。六味地黄丸属补益剂，，功能滋补肝肾。主要治疗肝肾阴虚证。肝肾阴亏，不能濡养腰膝，故腰膝酸软，肝肾阴亏，相火妄动，扰动精室，精关不固，故见遗精，阴虚失润，虚热内炽故见盗汗（A错）。肝肾阴亏不能上养清窍，故见耳鸣耳聋，肝阴亏虚，水不涵木，肝阳上扰，故头晕目眩（B错）。肝肾阴虚则生内热，故骨蒸潮热，手足心热（C错）。肝肾阴亏，虚热内生故小便淋沥，而小便不利或反多是肾阳虚衰的症状，肾阳不足，膀胱气化不利，故小便不利，肾阳虚，下元不固故小便增多。六味地黄丸主治肾阴虚（D对）。舌红少苔，脉沉细数为肝肾阴虚的舌脉（E错）。